字母S表示
A. 化学药品
B. 中药
C. 生物制品
D. 进口药品
E. 药用辅料

正确答案：C。生物制品